以下哪项不是复合树脂充填时洞壁制成斜面的目的
A. 增加酸蚀面积
B. 增加抗力
C. 增加固位
D. 减少复合树脂聚合收缩产生的釉质裂纹
E. 更加美观

正确答案：B。增加抗力

解析：本题考查复合树脂充填时洞壁制成斜面的目的。洞缘斜面处的复合树脂修复体薄弱，受力易折裂，并没有增加抗力的作用（B错，为本题的正确答案）。复合树脂充填时洞缘制成斜面的目的是使釉柱充分暴漏，能增加酸蚀面积，获得有效的酸蚀（A对）。粘接面积增加，粘接力也相应的增加，因此固位更好（C对）。洞缘的斜面能够使复合树脂更好的与牙体的颜色交织，可以减少复合树脂聚合收缩产生的釉质裂纹（D对），更加美观（E对）。